正常人空腹血糖水平约在（mmol/L）
A. 0～2
B. 2～4
C. 4～6
D. 6～8
E. 8～10

正确答案：C。4～6

解析：本题考查磷酸戊糖与血糖调节。血液中的葡萄糖称为血糖。血糖含量随进食、运动等变化而有所波动，但空腹血糖水平相当恒定，维持在3.89～6.11mmol/L（C对）。